治疗热哮的方剂是
A. 平喘固本汤
B. 金水六君煎
C. 六君子汤
D. 三子养亲汤
E. 定喘汤

正确答案：E。定喘汤

解析：定喘汤加减可以清热宣肺，化痰定喘，用于治疗热哮证（E对）。平喘固本汤（A错）用于肺肾气虚症的治疗。金水六君煎（B错）可滋养肺肾，祛湿化痰，用于肺肾阴虚，湿痰内盛证的治疗。六君子汤（C错）可益气健脾，燥湿化痰，用于脾胃气虚兼痰湿证的治疗。三子养亲汤（D错）可温肺化痰，降气消食，用于寒痰夹食证的治疗。